食管末端左缘与胃底所形成的锐角称
A. 角切迹
B. 贲门切迹
C. 幽门管
D. 胃道
E. 胃穹窿

正确答案：B。贲门切迹

解析：贲门切迹(B对)为食管末端左缘与胃底形成的锐角，角切迹(A错)为胃小弯最低点弯度转折处，幽门管(C错)为胃的幽门与中间沟之间的部分，胃道(D错)为胃小弯内部纵行粘膜皱襞间沟，胃穹窿(E错)为胃底。